全口义齿基托与唾液或黏膜与唾液之间产生的力称为
A. 大气压力
B. 黏着力
C. 附着力
D. 摩擦力
E. 内阻力

正确答案：C。附着力

解析：吸附力：吸附力是两种物体分子之间相互的吸引力，包括附着力和内聚力。附着力是指不同种分子之间的吸引力。内聚力是指同种分子之间的内聚力。全口义齿的基托组织面和黏膜紧密贴合，其间有一薄层的唾液，基托组织面与唾液，唾液与黏膜之间产生了附着力，唾液本身分子之间产生内聚力（粘结力），而使全口义齿获得固位。吸附力的大小与基托和黏膜之间的接触面积、密合程度，以及有关系。接触面积越大越密合，其吸附力也就越大。吸附力的大小还和唾液的质和量有关系，如果唾液的黏稠度高，流动性小，可以加强附着力和内聚力，而增强义齿的固位。相反，如果唾液的黏稠度低，流动性大，则可减低固位作用。掌握“全口义齿固位及稳定”知识点。